性早熟
A. 女童在8岁以前出现乳房增大，阴毛、腋毛生长等第二性征的一种或一种以上者，均属性早熟
B. 包括真性性早熟和假性性早熟
C. 原则上是针对病因进行治疗。治疗目的在于抑制排卵、抑制月经、减慢第二性征的发育，预防身材过矮，促进身心的协调发展和心理健康
D. 女童在14岁以前出现第二性征发育，属性早熟
E. 由肿瘤引起的假性性早熟，尚无特殊疗法，可用大剂量孕激素抑制促性激素的分泌，其效果观察6～12个月

正确答案：A。女童在8岁以前出现乳房增大，阴毛、腋毛生长等第二性征的一种或一种以上者，均属性早熟

解析：本题考查性早熟的定义。性早熟是指第二性征出现的年龄比预计青春期发育年龄早2.5个标准差，女童在8岁以前出现任何一种或一种以上第二性征的发育（A对BCDE错），第二性征发育即乳房增大、阴毛、腋毛生长等。